以下关于粘结力的说法哪项是错误的
A. 与技术操作有关
B. 与粘结剂稠度成正比
C. 与粘结剂厚度成反比
D. 与粘结面积成正比
E. 与粘结剂性能有关

正确答案：B。与粘结剂稠度成正比

解析：本题考查修复体试戴、磨光与粘固。以下关于粘结力的说法与粘结剂稠度成正比（B错，为本题正确答案）是错误的。粘接剂过稀或过稠均可影响粘接力。粘结力的大小受以下因素的影响：①粘结力与粘结面积成正比（D对），在同样情况下，粘结面积大，粘结力就强。②粘结力与粘固剂的厚度成反比（C对）。粘固剂厚，则抗折断力弱，粘结力小。粘固剂薄，抗折断力则强，粘结力就大。因此，应要求粘结面尽量密合。③粘固剂的稠度应适当，过稀过稠都影响粘结力。常用的磷酸锌粘固剂，其稠度以调和刀粘起粘固剂时，呈长丝状为宜。过稀其粘结力及抗压碎力差，且游离磷酸刺激牙髓。过稠则不但凝固快，不便操作，且涂布不匀，增加粘固剂的厚度，影响修复体的准确就位。④修复体或制备牙的粘结面上有水分、氧化物、油质残渣等异物，都会影响粘结力。因此，要在牙的窝洞及调拌器均清洁与干燥的环境下，粘接固定。树脂粘接剂与牙和修复体均有较强的粘结强度，可明显增强固位力（AE对）。